《麻醉药品和精神药品管理条例》对药品零售连锁企业经营二类精神药品的要求包括
A. 实行专人管理
B. 建立专用账册
C. 设立独立的专库或专柜存储
D. 实行双人双锁管理
E. 设立监控报警设施

正确答案：A、B、C。实行专人管理；建立专用账册；设立独立的专库或专柜存储

解析：本题考查第二类精神药品的储存。《麻醉药品和精神药品管理条例》对药品零售连锁企业经营二类精神药品的储存的要求包括实行专人管理（A对）、建立专用账册（B对）、设立独立的专库或专柜存储（C对）。第二类精神药品经营企业，应当在药品库房中设立独立的专库或者专柜储存第二类精神药品，并建立专用账册，实行专人管理。专用账册的保存期限应当自药品有效期期满之日起不少于5年。麻醉药品与第一类精神药品的专库储存：定点生产企业、全国性批发企业和区域性批发企业应当设置储存麻醉药品和第一类精神药品的专库，严格执行专库储存管理规定，将麻醉药品与第一类精神药品储存在符合要求的专库中。专库的要求是：安装专用防盗门，实行双人双锁管理（D错）；具有相应的防火设施；具有监控设施和报警装置（E错），报警装置应当与公安机关报警系统联网。麻醉药品和第一类精神药品的使用单位应当设立专库或者专柜储存麻醉药品和第一类精神药品。专库应当设有防盗设施并安装报警装置；专柜应当使用保险柜。专库和专柜应当实行双人双锁管理。